根治原发性肝癌最好的方法是
A. 化学抗癌药物治疗
B. 手术切除治疗
C. 放射治疗
D. 中医治疗
E. 生物和免疫治疗

正确答案：B。手术切除治疗

解析：手术切除治疗（B对）可直接切除病灶，5年生存率较高，是根治原发性肝癌最好的方法。化学抗癌药物治疗（A错）、放射治疗（C错）、中医治疗（D错）、生物和免疫治疗（E错）只作为手术前、后的辅助治疗或不能适用手术时采用的姑息性治疗。